女性，67岁，无牙颌，全口义齿初戴时发现，上颌义齿在休息状态及咀嚼时不松动，但说话和大张口时易脱落。其原因是
A. 基托边缘封闭差
B. 基托不密合
C. 基托边缘过短
D. 基托边缘过度伸展
E. 人工牙咬合不平衡

正确答案：D。基托边缘过度伸展

解析：当口腔处于休息状态时，义齿固位尚好，但张口、说话、打哈欠时义齿易脱位，这是由于基托边缘过长、过厚；唇、颊、舌系带区基托边缘缓冲不够，影响系带活动；人工牙排列的位置不当，排列在牙槽嵴顶的唇颊或舌侧，影响周围肌肉的活动；义齿磨光面外形不好等造成的。应磨改基托过长或过厚的边缘，缓冲系带部位的基托，形成基托磨光面应有的外形，或适当磨去部分人工牙的颊舌面，减小牙齿的宽度。掌握“全口义齿戴入后问题及处理”知识点。